局麻药引起局麻作用的电生理学机制是
A. 促进Na+内流
B. 阻止Na+内流
C. 促进Ca2+内流
D. 阻止Ca2+内流
E. 阻止K+外流

正确答案：B。阻止Na+内流

解析：神经动作电位的产生是由于神经受刺激时引起膜性通透性的改变，产生Na+内流和K+外流。局麻药的作用就是阻止这种通透性的改变，使Na+在其作用期间内不能进入细胞。掌握“局麻药”知识点。